患者，女，50岁。右耳垂下无痛性肿物，缓慢生长6年。触诊肿块界限清，可活动，约4.0cm×4.0cm×3.0cm大小，质地中等，扪诊呈结节状，高起处常较软，与皮肤无粘连。根据上述症状，该患者最可能的诊断是右侧腮腺
A. 皮脂腺囊肿
B. 皮样囊肿
C. 腺淋巴瘤
D. 混合瘤
E. 淋巴结炎

正确答案：D。混合瘤

解析：本题考查唾液腺疾病。患者女，50岁，右耳垂下无痛性肿物（无自觉症状），缓慢生长6年（病史长）。触诊肿块界限清，可活动（活动性），约4.0cm×4.0cm×3.0cm大小，质地中等，扪诊呈结节状，高起处常较软，与皮肤无粘连。上述症状，该患者最可能的诊断是右侧腮腺混合瘤（D对）。混合瘤又叫多形性腺瘤，多发于30～50岁女性，最常见于腮腺，可有囊性变，低凹处较硬，多为实质性组织。腺淋巴瘤（C错）多见于男性，患者常有吸烟史，多数位于腮腺后下极，扪诊肿瘤呈圆形或卵圆形，表面光滑，质地较软，有时有弹性感。皮脂腺囊肿（A错）好发于皮脂腺丰富部位，未合并感染时，患者一般无自觉症状，肿物呈球形，单发或多发，大小不等，中等硬度，有弹性，与皮肤有粘连，不易推动。皮样囊肿（B错）主要表现为皮下无痛性结节，结节可以随着年龄增长而缓慢增大，直径一般为0.5～5厘米，通常单个出现，呈圆形，活动度较小，患者通常没有明显的症状。淋巴结炎（E错）主要表现为淋巴结肿大和疼痛，可出现如玻璃球大小的结节，触感坚硬，局部红肿压痛。